单侧翼外肌亢进
A. 偏向患侧
B. 偏向健侧
C. 先偏向患侧后又回到中线
D. 不偏
E. 开口型歪曲

正确答案：B。偏向健侧

解析：翼外肌功能亢进：主要症状是弹响和开口过大。弹响发生在一侧时，开口型在开口末偏向健侧；双侧均有弹响时，开口型不偏斜或偏向翼外肌收缩力较弱侧。一般无疼痛。掌握“颞下颌关节紊乱”知识点。